对有心脑血管疾病的患者，以下关于术前准备的说法错误的是
A. 纠正水、电解质代谢紊乱
B. 脑卒中者择期手术至少推迟2周后
C. 高血压患者术前继续服药
D. 心肌梗死发病后2个月安排择期手术
E. 不要求血压降至正常后手术

正确答案：D。心肌梗死发病后2个月安排择期手术

解析：心肌梗死应在发病6个月后安排择期手术（D错，为本题正确答案）。纠正水、电解质代谢紊乱为一般的术前准备（A对）；脑卒中者择期手术至少推迟2周，最好6周（B对）；高血压患者应在术前继续服药（C对），避免戒断综合征；但不必降至正常，只要平稳即可（E对）。